与津液代谢关系最为密切的是哪一组脏腑
A. 心肝肾
B. 心脾肾
C. 脾肝肾
D. 脾肺肾
E. 脾胃肾

正确答案：D。脾肺肾

解析：津液的生成、输布、和排泄过程即津液代谢，与多个脏腑的生理功能有关，是多脏腑相互协调、密切配合而完成的，但以肺脾肾三脏的功能最为重要（D对ABCE错）。